男，60岁。右下678左下678缺失，余留牙不松动，牙槽嵴正常，若在右下5左下5上放置RPI卡环组，其主要作用不包括
A. 减小对基牙的扭力
B. 减轻牙槽嵴负荷
C. 防止义齿向远中移位
D. 不需要舌侧对抗卡环臂
E. 卡环与基牙接触面积小

正确答案：B。减轻牙槽嵴负荷

解析：RPI卡环组：①近中（牙合）支托义齿受力后，即使有使基牙向近中倾斜的分力，由于得到近中余留牙的支持，可以保持不动。因此，用近中（牙合）支托可消除或减少基牙所受的扭力。近中支托虽然可减少基牙所受的扭力，但加大了牙槽嵴的负担。②近中支托的小连接体和邻面板，可保证必须的对抗作用，因此不需舌侧对抗臂，患者感觉舒适。③I形卡环臂与牙的接触面小，美观，产生龋病和牙周病的机会少。掌握“局部义齿固位体”知识点。